关于《新编药物学》的叙述，错误的是
A. 是由陈新谦、金有豫主编的
B. 是由人民卫生出版社出版的
C. 是我国目前知名度最高的药品集
D. 可查阅疾病的诊断知识和药物治疗学
E. 可查阅药品性状、药理作用及临床应用、用法和注意事项

正确答案：D。可查阅疾病的诊断知识和药物治疗学